患者痫病久发，头晕目眩，两目干涩，心烦失眠，腰膝酸软，舌红少苔，脉细数。治疗应首选的方剂是
A. 醒脾汤
B. 黄连温胆汤
C. 龙胆泻肝汤合涤痰汤
D. 左归丸
E. 定痫丸

正确答案：D。左归丸

解析：本题患者有癫痫病史，肝肾亏虚，水不涵木，肝阳上亢，则头晕目眩；目得血而能视，肝血不足，目失濡养，则两目干涩；腰膝失于滋养，则腰膝酸软；阴虚则热，虚热上扰，心神不宁，则心烦失眠，舌红少苔，脉细数为阴虚内热之象，所以该患者为肝肾阴虚证，宜用具有补益肝肾，育阴息风的左归丸（D对）；醒脾汤用于痫病日久、神疲乏力、眩晕时作、面色不华、胸闷痰多、或恶心欲呕、纳少便溏、舌淡胖、苔白腻、脉濡弱的脾虚痰湿证（A错）；黄连温胆汤可以治疗胆郁痰扰证，证见胆怯易惊，头眩心悸，心烦不眠，夜多异梦，耳鸣耳聋；或呕恶呃逆，眩晕，癫痫。苔白腻，脉弦滑（B错）；龙胆泻肝汤合涤痰汤用于平素性情急躁、心烦失眠、口苦咽干、时吐痰涎、大便秘结、发作则昏仆抽搐、口吐涎沫、舌红、苔黄、脉弦滑数的肝火痰热证（C错）；定痫丸用于阳痫症状：突然仆倒，不省人事，面色潮红，牙关紧闭，两目上视，四肢抽搐，口吐涎沫；或喉中痰鸣或发怪叫，移时苏醒如常人，发病前常有眩晕、头昏、胸闷、乏力，舌质红，苔白腻或黄腻，脉弦数或弦滑（E错）。